雌二醇口服几乎无效，临床常用雌二醇贴片。近年来，随着微粒化技术问世，市面上亦出现了雌二醇片。某患者使用微粒化雌二醇片治疗雌激素缺乏综合征，每次2mg，每天服药一次，使用一段时间后，出现肝功能异常，后改用雌二醇贴片（每片2.5mg，每片可使用7日），不良反应消失。关于雌二醇贴片特点的说法，错误的是
A. 不存在皮肤代谢
B. 避免药物对胃肠道的副作用
C. 避免峰-谷现象，降低药物不良反应
D. 出现不良反应时，可随时中断给药
E. 适用于不宜口服给药及需要长期用药的患者

正确答案：A。不存在皮肤代谢

解析：本题考查贴剂。贴剂存在皮肤的代谢作用（A错，为本题正确答案）。贴剂系指原料药物与适宜的材料制成的供黏贴在皮肤上的可产生全身或局部作用的一种薄片状制剂。贴剂的优点有：（1）避免了口服给药的肝首关效应及胃肠灭活；（2）维持恒定有效的血药浓度，减少胃肠给药的副作用（B对）；（3）延长作用时间，减少用药次数；（4）避免峰谷现象，降低药物不良反应（C对）；（5）患者可以自行用药（E对），发现副作用可随时中断给药（D对）；贴剂的局限性：（1）由于起效慢，不适合要求起效快的药物；（2）大面积给药，可能会对皮肤产生刺激性和过敏性；（3）存在皮肤的代谢与贮库作用；（4）药物吸收的个体差异和给药部位的差异较大。